急性血源性骨髓炎好发年龄应该是
A. 婴幼儿
B. 儿童及青少年
C. 青年
D. 中壮年
E. 老年

正确答案：B。儿童及青少年

解析：急性血源性骨髓炎多发生于儿童及青少年（B对），12岁以下的儿童约占80%以上。儿童好发于长骨干骺端，这是由于儿童骨骺板附近的微小终末动脉与毛细血管易形成血管襻，该处血流丰富而流动缓慢，使细菌更易沉积，因此少年长骨干骺端为好发部位。